不属于药物稳定性试验方法的是
A. 高湿试验
B. 加速试验
C. 随机试验
D. 长期试验
E. 高温试验

正确答案：C。随机试验

解析：本题考查药物稳定性试验方法。不属于药物稳定性试验方法的是随机试验（C错，为本题正确答案）。随机试验一般用于药物的质量检查，不属于药物稳定性试验的方法。药物稳定性试验方法主要包括：1.影响因素试验；2.加速试验（B对）；3.长期试验等（D对）。高湿试验（A对）与高温试验（E对）属于影响因素试验。